万古霉素0.5g加入5%葡萄糖注射液100ml中静脉滴注，要求滴注时间不得少于1h。已知每毫升15滴，每分钟最多可滴注的滴数约是
A. 7滴
B. 15滴
C. 25滴
D. 50滴
E. 60滴

正确答案：C。25滴

解析：本题考查滴数的计算。已知：液体总量为100ml，滴系数=15，输液时间=1h=60min。根据：输液时间（min）=要输入的液体总量（ml）×滴系数/每分钟的滴数可知，每分钟的滴数=液体总量×滴系数/输液时间=100×15/60=25滴（C对）。